预防先兆流产的是
A. 甲睾酮
B. 甲羟孕酮
C. 他莫昔芬
D. 麦角生物碱
E. 缩宫素

正确答案：B。甲羟孕酮

解析：本题考查预防先兆流产的药物。甲羟孕酮（B对）属于孕激素类药，用于功能性子宫出血，痛经和子宫内膜异位症，先兆性流产及习惯性流产，对子宫内膜癌、良性前列腺肥大及前列腺癌等也有一定的治疗作用，避孕。甲睾酮（A错）属于雄激素。他莫昔芬（C错）为抗雌激素药物。麦角生物碱（D错）和缩宫素（E错）都属于子宫平滑肌兴奋药。